药品批准文号标号前注S和生产企业所在地简称者为
A. 辅料
B. 西药
C. 生物制品
D. 中药
E. 进口原料药生产的制剂

正确答案：C。生物制品

解析：本题考查药品批准文号的格式。药品批准文号标号前注S和生产企业所在地简称者为生物制品（C对）。药品批准文号的格式为：国药准字H（Z、S、J）+4位年号+4位顺序号，其中H代表化学药品，Z代表中药（D错），S代表生物制品，J代表进口药品分包装（E错）。